慢性盆腔炎湿热瘀结证,治疗首选
A. 仙方活命饮
B. 当归芍药散
C. 银甲丸
D. 大黄牡丹汤
E. 膈下逐瘀汤

正确答案：C。银甲丸

解析：慢性盆腔炎湿热瘀结证，治以清热利湿，化瘀止痛，用银甲丸，此方来源于《王渭川妇科经验选》原方治湿热蕴结下焦的黄白带、赤白带等炎症性疾病（C对）。急性盆腔炎湿热瘀结证用仙方活命饮（A错）。当归芍药散不用于治疗盆腔炎（B错）。急性盆腔炎热毒炽盛证用大黄牡丹汤（D错）。慢性盆腔炎气滞血瘀证用膈下逐瘀汤（E错）。